患者因皮肤疮痍破溃而引发水肿，肿势自颜面渐及全身，小便不利，恶风发热，咽红，舌红苔薄黄，脉滑数。治疗应首选
A. 越婢加术汤合桑白皮汤
B. 麻黄连翘赤小豆汤合五味消毒饮
C. 麻黄连翅赤小豆汤合五皮散
D. 麻黄连翘赤小豆汤合猪苓汤
E. 实脾饮合五味消毒饮

正确答案：B。麻黄连翘赤小豆汤合五味消毒饮

解析：肌肤乃皮肺所主之域，故肌肤疮痍；湿毒未能及时清解消散，内归脏腑，使中焦脾胃不能运化水湿，失其升清降浊之能，使肺不能通调水道而小便不利；风为百病之长，故病之初起，多兼风邪，是以肿起颜面渐及全身，有恶风发热之象；咽红，舌红苔薄黄，脉滑数是风邪夹湿毒所致。故辩证为水肿湿毒浸淫证，治宜宣肺解毒，利湿消肿，方选：麻黄连翘赤小豆汤合五味消毒饮（B对）。越婢加术汤功能宣肺清热、祛风利水为治疗水肿阳水之风水相搏证的选方；桑白皮汤功能清热肃肺化痰，用于治疗喘证痰热郁肺证或肺脏痰热郁肺证（A错）。麻黄连翅赤小豆汤功能宣肺利尿，常合五味消毒饮治疗水肿湿毒浸淫证；五皮散功能利水消肿，理气健脾，常合葶苈大枣泻肺汤治疗湿热壅盛证肿势严重，兼见气粗喘满，倚息不得卧，脉弦有力者，（第五版教材P289-290）（C错）。麻黄连翘赤小豆汤功能宣肺利尿，常合五味消毒饮治疗水肿湿毒浸淫证；猪苓汤功能滋阴清热利水，为治疗湿热壅盛证出现湿热久羁者的选方，（第五版教材P290）（D错）。实脾饮功能健运脾阳，为治疗水肿阴水脾阳虚衰证的选方，五味消毒饮功能清热解毒，消散疔疮，主治疔疮初起，发热恶寒，疮形如粟，坚硬根深，状如铁钉，以及痈疡疖肿，红肿热痛（E错）。